可致肌痛、骨关节病损、跟腱断裂的药物
A. 氟喹诺酮类
B. 大环内酯类
C. 氨基糖苷类
D. 四环素类
E. 酰胺醇类(氯霉素）

正确答案：A。氟喹诺酮类

解析：本题考查氟喹诺酮类。氟喹诺酮类（A对）可致肌痛、骨关节病损、跟腱炎症和跟腱断裂。大环内酯类（B错）可引起药疹和药物热，偶可引起过敏和暂时性耳聋，以及皮炎、会阴糜烂等，甚至休克。氨基糖苷类（C错）药物都有不同程度的耳毒性、肾毒性和神经肌肉阻滞作用。四环素类（D错）会选择性沉积在牙齿和骨骼中。酰胺醇类(氯霉素）（E错）可致不可逆性的骨髓功能抑制，引起再生障得性贫血，儿童需慎用。